对布氏杆菌叙述错误的是
A. 是波浪热的病原体
B. 分6个菌种，我国流行羊氏、牛氏菌种
C. 为G+小杆菌
D. 孕期动物对布鲁氏菌最易感
E. 主要通过接触经呼吸道皮肤等途径传播

正确答案：C。为G+小杆菌

解析：布鲁菌属是一种需氧型革兰氏阴性短小杆菌，其致病物质主要为内毒素还有侵袭性酶（透明质酸酶、过氧化氢酶等），人类主要通过介乎病畜或者接触被污染的畜产品，经皮肤、黏膜、眼结膜、消化道、呼吸道等不同途径感染。布鲁菌属感染母畜引起母畜流产。布鲁菌属侵入人体在潜伏期内形成胞内寄生菌，大量繁殖以后入血形成菌血症导致体温升高呈“波浪热”热型。掌握“动物源性细菌”知识点。